今有一“红参”药材送检，经鉴定，其横切面有多数点状维管束排成数个同心环，味稍甜后微苦，久嚼麻舌，它是
A. 人参的根
B. 华山参的根
C. 商陆的根
D. 山莴苣的根
E. 野豇豆的根

正确答案：C。商陆的根